种子浸水后种皮成龟裂状的药材是
A. 牵牛子
B. 决明子
C. 沙苑子
D. 苦杏仁
E. 酸枣仁

正确答案：A。牵牛子

解析：本题考查的是牵牛子的性状鉴别。种子浸水后种皮成龟裂状的药材是牵牛子（A对）。牵牛子：【性状鉴别】药材似橘瓣状。表面灰黑色或淡黄白色，背面有1条浅纵沟，腹面棱线的下端有一点状种脐，微凹。质硬，横切面可见淡黄色或黄绿色皱缩折叠的子叶，微显油性。气微，味辛、苦，有麻感。加水浸泡后种皮呈龟裂状，手捻有明显的黏滑感。决明子（B错）：【性状鉴别】药材决明略呈菱状方形或短圆柱形，两端平行倾斜。表面绿棕色或暗棕色，平滑有光泽。一端较平坦、另端斜尖，背腹面各有1条突起的棱线，棱线两侧各有1条斜向对称而色较浅的线形凹纹。质坚硬，不易破碎。种皮薄，子叶2，黄色，呈“S”形折曲并重叠。气微，味微苦。沙苑子（C错）：【性状鉴别】药材略呈圆肾形而稍扁。表面绿褐色至灰褐色，光滑，边缘一侧微凹处具圆形种脐。质坚硬，不易破碎。除去种皮，有淡黄色子叶2片，胚根弯曲。气微，味淡，嚼之有豆腥味。苦杏仁（D错）：【性状鉴别】药材呈扁心形。表面黄棕色至深棕色，一端尖，另端钝圆，肥厚，左右不对称，尖端一侧有短线形种脐，圆端合点处向上具多数深棕色的脉纹。种皮薄，子叶2，乳白色，富油性。气微，味苦。酸枣仁（E错）：【性状鉴别】药材呈扁圆形或扁椭圆形。表面紫红色或紫褐色，平滑有光泽，有的有裂纹。有的两面均呈圆隆状突起；有的一面较平坦，中间有1条隆起的纵线纹，另一面微隆起，边缘略薄。一端凹陷，可见线形种脐，另一端有细小突起的合点。种皮较脆，胚乳白色，子叶2，浅黄色，富油性。气微，味淡。